女，45岁。发热、胸闷2周，伴膝关节疼痛不适，胸部X线片示右侧中等量胸腔积液，胸水常规检查示有核细胞数1200×10⁴/L，单核细胞0.87，多核细胞0.10，间皮细胞0.03，LDH320U/L，ADA54U/L，总蛋白45g/L。该患者胸腔积液产生最主要的机制是
A. 胸膜毛细血管通透性增加
B. 胸膜毛细血管内静水压升高
C. 胸膜腔内胶体渗透压增加
D. 血浆胶体渗透压降低
E. 淋巴管阻塞

正确答案：A。胸膜毛细血管通透性增加

解析：患者胸水总蛋白45g/L（为渗出液），单核细胞多，多核细胞少（以淋巴单核细胞为主，中性粒细胞少），LDH320U/L，ADA54U/L，该患者胸腔积液最可能的诊断是结核性胸腔积液。胸腔积液常见病因和发病机制有：①胸膜毛细血管内静水压升高（B错）：如充血性心力衰竭、缩窄性心包炎。②胸膜毛细血管通透性增加（A对）：如胸膜炎症（肺结核、肺炎）、风湿性疾病、胸膜肿瘤（恶性肿瘤转移、间皮瘤）。③胸膜毛细血管内胶体渗透压降降低（CD错）：如低蛋白血症、肝硬化、肾病综合征。④淋巴管阻塞（E错）：癌症淋巴管阻塞、发育性淋巴管引流异常等。